动作电位下降支是由于
A. K⁺内流
B. Cl⁻内流
C. Na⁺内流
D. K⁺外流
E. Ca²⁺内流

正确答案：D。K⁺外流

解析：当正离子由膜外向膜内转运（如Na⁺、Ca²⁺内流）或负离子由膜内向膜外转运（如Cl⁻外流）时膜发生去极化，形成动作电位的上升支；当正离子由膜内向膜外转运（如K⁺外流）（D对）或负离子由膜外向膜内转运（如Cl⁻内流）时膜发生复极化，形成动作电位的下降支。